女性，30岁，4小时前跌伤后昏迷5分钟，清醒后步行回家。1小时前因剧烈头痛，呕吐3次送来急诊。查体：昏迷，P64次/分，BP180/90mmHg，R18次/分，左瞳3mm，右瞳2mm，右上下肢肌力Ⅲ级。应立即采取的检查方法是
A. 脑电图
B. 脑血管造影
C. 头部CT
D. 眼底检查
E. 心电图

正确答案：C。头部CT

解析：应立即采取的检查方法是头部CT（C对），不仅可以直接显示硬脑膜外的血肿，还可以了解到脑室受压及中线结构移位的程度及并存的脑挫裂伤、脑水肿等情况，对疾病的诊断和治疗具有重要意义。脑电图（A错）主要用于癫痫和精神性疾病的诊断，对急性硬膜外血肿无诊断价值。脑血管造影（B错）主要用于动静脉畸形、动静脉瘘及蛛网膜下腔出血等疾病的诊断，而急性硬膜外血肿的主要来源为脑膜中动脉，因此对该患者无诊断价值。眼底检查（D错）主要用于视网膜、视神经疾病及高血压病、肾病、糖尿病等全身性疾病的诊断，对急性硬膜下血肿的诊断价值不大。心电图（E错）为一般常规检查，对急性硬膜下血肿无诊断价值。